呈丝条状，外表面黄色或黄棕色，内表面暗黄色或淡棕色，切面纤维性，呈裂片状分层，味极苦的饮片是
A. 黄柏
B. 牡丹皮
C. 白鲜皮
D. 肉桂
E. 地骨皮

正确答案：A。黄柏

解析：本题考查的是黄柏饮片的性状鉴别。呈丝条状，外表面黄色或黄棕色，内表面暗黄色或淡棕色，切面纤维性，呈裂片状分层，味极苦的饮片是黄柏（A对）。黄柏：【性状鉴别】饮片呈丝条状，外表黄褐色或黄棕色，内表面暗黄色或淡棕色，具纵棱纹。切面纤维性，呈裂片状分层，深黄色。味极苦。牡丹皮（B错）：【性状鉴别】饮片呈圆形或卷曲形的薄片。连丹皮外表面灰褐色或黄褐色，栓皮脱落处粉红色；刮丹皮表面红棕色或淡灰黄色。内表面有时可见发亮的结晶，切面淡粉红色，粉性。气芳香，味微苦而涩。白鲜皮（C错）：【性状鉴别】饮片呈不规则的厚片，外表面灰白色或淡灰黄色，具细纵皱纹及细根痕，常有突起的颗粒状小点；内表面类白色，有细纵纹。切面类白色，略呈层片状。有羊膻气，味微苦。肉桂（D错）：【性状鉴别】饮片呈槽状或卷筒状。外表面灰棕色，稍粗糙，有不规则的细皱纹及横向突起的皮孔，有的可见灰白色的斑纹；内表面红棕色，较平坦，有细纵纹，划之显油痕。质硬而脆，易折断，断面不平坦，外层棕色而较粗糙，内层红棕色而油润，两层中间有1条黄棕色的线纹。气香浓烈，味甜、辣。地骨皮（E错）：【性状鉴别】饮片呈筒状或槽状，长短不一。外表面灰黄色至棕黄色，粗糙，有不规则纵裂纹，易成鳞片状剥落。内表面黄白色至灰黄色，较平坦，有细纵纹。体轻，质脆，易折断，断面不平坦。外层黄棕色，内层灰白色。气微，味微甘而后苦。